以下哪项不属于孕中期保健应做的工作
A. 监测胎儿生长发育
B. 做孕期营养指导
C. 做必要的产前诊断，如B超、羊水穿刺
D. 取绒毛行染色体检查
E. 定时测量宫底高度

正确答案：D。取绒毛行染色体检查

解析：本题考查孕中期保健应做的工作。取绒毛行染色体检查（D错，为本题正确答案）是为了检查遗传病，应该是在孕早期保健做的工作。孕中期保健应做的工作：做必要的产前诊断，如B超、羊水穿刺（C对）；做孕期营养指导（B对）；监测胎儿生长发育（A对）；定时测量宫底高度（E对）等。